下列哪项不符合老年营养的需要
A. 应该大量补钙
B. 脂肪摄入不宜过多
C. 蛋白质量适而质优
D. 总热能摄入量应降低
E. 不宜食用含蔗糖高的食物

正确答案：A。应该大量补钙